患者肺胀病史20年，呼吸浅促难续，声低气怯，倚息不能平卧，胸闷如窒，心慌，咳痰不爽，脉沉数无力。治疗应首选
A. 金匮肾气丸
B. 平喘固本汤
C. 真武汤
D. 大补元煎
E. 七味都气丸

正确答案：B。平喘固本汤

解析：患者为肺胀病人。肺肾气虚则不能主气、纳气，故呼吸浅短，声低气怯，倚息不能平卧，胸闷如窒；肺病及心，心气虚弱，故心悸；寒饮伏肺，肾虚水泛，则咳痰不爽；肺失治节，气不帅血，气滞血瘀，则脉沉数无力。治疗当以补肺纳肾，降气平喘为法。方剂选平喘固本汤，此方既可补肺纳肾，又可降气化痰，从而达到止喘的目的（B对）。金匮肾气丸，温补肾阳，化气行水。用于肾虚水肿，腰膝酸软，小便不利，畏寒肢冷，而非定喘专方（A错）。真武汤，中医方剂名。为祛湿剂，具有温阳利水之功效。主治阳虚水泛证（C错）。大补元煎治疗年老体虚，中气不足，重度子宫脱垂。（D错）。七味都气丸为固涩剂，具有补肾纳气，涩精止遗功效。用于虚不能纳气之喘促，或久咳而咽干气短，遗精盗汗，小便频数（E错）。